伤寒发病至第二周，微生物学检查分离培养时常采取的标本是
A. 骨髓
B. 血液
C. 尿
D. 便
E. 十二指肠液

正确答案：D。便

解析：伤寒标本检查第1周取外周血，第2周起取粪便，第3周起还可取尿液，从第1周至第3周均可取骨髓液。掌握“志贺氏及沙门氏菌属”知识点。